男，6岁。浮肿尿色红2天入院，查体：颜面眼睑浮肿，心肺听诊无异常，尿常规有红细胞（+++），蛋白（+），半月前患过扁桃体炎，首先考虑的诊断是
A. 急性泌尿系统感染
B. 急进性肾炎
C. 单纯性肾病
D. 肾炎性肾病
E. 急性肾小球肾炎

正确答案：E。急性肾小球肾炎

解析：患儿有水肿，肉眼血尿，尿红细胞（＋），尿蛋白（＋），且半月前有前驱感染史，首先考虑诊断急性肾小球肾炎（E对）。患儿无发热、尿道综合征等泌尿系感染的表现（A错），无肾功能不全表现（B错），尿常规有红细胞（+++），蛋白（+），不能诊断为单纯性肾病（C错），尿蛋白量不高且未提示低蛋白血症，不能诊断为肾病综合征（D错）。